残胃癌发生在因良性病变施行胃大部切除术后至少
A. 1年
B. 2年
C. 3年
D. 4年
E. 5年

正确答案：E。5年

解析：残胃癌指因良性病变施行胃大部切除术后5年以上（E对），残胃出现的原发癌，是胃大部切除术的远期并发症之一。